女，64岁。右膝疼痛10年，加重半年。查体：右膝肿胀，屈曲内翻畸形。X线片见关节间隙严重狭窄，关节边缘大量骨赘形成。最佳治疗方案是
A. 制动和理疗
B. 关节融合术
C. 人工关节置换术
D. 口服非甾体抗炎药
E. 滑膜切除术

正确答案：C。人工关节置换术

解析：患者老年女性，右膝疼痛10年伴肿胀、屈曲内翻畸形（膝关节骨关节炎典型表现），X线片见膝关节间隙狭窄伴骨赘形成（骨关节炎典型影像学表现），结合患者的症状、体征和影像学检查，该患者最可能的诊断为右膝关节骨关节炎。由于患者年龄较大，疼痛明显，且已有屈曲内翻畸形，X线显示有严重的关节面破坏，故为防止关节破坏进一步加重、减轻患者疼痛，最佳治疗方案是人工关节置换术（C对）。制动和理疗（A错）、口服非甾体抗炎药（D错）等非手术治疗适用于初诊、症状较轻的患者。关节融合术（B错）是一种人为导致关节骨性强硬的手术，关节融合后关节活动功能丧失，不宜选用。滑膜切除术（E错）适用于早中期滑膜增生较轻的病例，该患者已发展至终末期，故不适用。